环孢素临床用于
A. 镇静催眠
B. 降血糖
C. 器官移植后的排异反应
D. 抗菌
E. 抗肿瘤

正确答案：C。器官移植后的排异反应